直接感染和裂解CD4+Th细胞，造成严重免疫缺陷的
A. 流感病毒
B. 布氏杆菌
C. 结核杆菌
D. HIV
E. EB病毒

正确答案：D。HIV

解析：一些寄生虫可产生补体抑制分子类似物，抑制补体系统激活而抵御补体激活所致的寄生虫杀伤。HIV可直接感染和裂解CD4+Th细胞，造成严重免疫缺陷。掌握“抗感染免疫”知识点。